患者突然昏倒，神离不清，口吐涎沫，两目上视，四肢抽搐，口中怪叫，移时苏醒，舌苔白腻，脉弦滑。治疗首选
A. 导痰汤
B. 二阴煎
C. 控涎丹
D. 涤痰汤
E. 定痫丸

正确答案：E。定痫丸

解析：癫痫阳痫其机理为肝风内动，痰随风动，风痰上扰，心神被蒙，故治法为急以开窍醒神，继以泻热涤痰息风，方药选用黄连解毒汤和定痫丸加减（E对）。导痰汤（A错）用于治疗痰热上扰证。二阴煎（B错）用于治疗中风血不养筋，及疟疾汗多。控涎丹（C错）用于治疗痰饮内伏。涤痰汤（D错）用于治疗中风痰迷心窍，舌强不能言。